痫证风痰闭阻的治法是
A. 涤痰熄风，开窍定痫
B. 清肝泻火，化痰开窍
C. 涤痰开窍，化瘀通络
D. 熄风开窍，化痰定志
E. 化痰通络，镇心安神

正确答案：A。涤痰熄风，开窍定痫

解析：痫病风痰闭阻证是由痰浊素盛，肝阳化风，痰随风动，风痰闭阻，上干清窍所致。治疗宜涤痰熄风，开窍定痫，代表方为定痫丸（A对）。清肝泻火，化痰开窍，是痫病之痰火扰神证的治法(B错)。选项涤痰开窍，化瘀通络，选项熄风开窍，化痰定志和选项化痰通络，镇心安神均不是痫病的治法（CDE错）。